我国主要医疗保险模式不包括
A. 国家医疗保险
B. 商业型医疗保险
C. 储蓄医疗保险
D. 新型农村合作医疗
E. 社会医疗保险

正确答案：D。新型农村合作医疗

解析：我国主要医疗保险模式：国家医疗保险；社会医疗保险；商业型医疗保险；储蓄医疗保险。掌握“医疗保障”知识点。